对第一恒磨牙进行窝沟封闭的适宜年龄是
A. 6～7岁
B. 8～9岁
C. 10～11岁
D. 12～13岁
E. 14～15岁

正确答案：A。6～7岁

解析：本题考查窝沟封闭的时机。对第一恒磨牙进行窝沟封闭的适宜年龄是6～7岁（A对）。封闭时机以磨牙萌出后达到咬合平面最为合适。一般乳磨牙在3～4岁，第一恒磨牙在6～7岁，第二恒磨牙在11～13岁为最适直封闭的年龄。